奥美拉唑减少胃酸分泌主要通过
A. 灭活胃壁H⁺泵
B. 阻断组胺受体
C. 阻断5-HT受体
D. 阻断M受体
E. 阻断DA受体

正确答案：A。灭活胃壁H⁺泵

解析：本题考查奥美拉唑的作用机制。奥美拉唑属于质子泵抑制剂类抑酸剂（A对），通过抑制质子泵（H⁺，K⁺-ATP酶）的活性来抑制胃酸分泌；阻断组胺受体（B错）减少胃酸分泌的药物是组胺H₂受体拮抗剂，如西咪替丁；阻断5-HT受体（C错）不能减少胃酸分泌；阻断M受体（D错）可起到解痉作用；DA受体阻断剂（E错）可作为促胃肠动力药，如甲氧氯普胺。